不易通过乳腺输送到乳汁中的营养素是
A. 铁
B. 钙
C. 维生素A
D. 维生素C
E. 维生素E

正确答案：A。铁

解析：本题考查不易通过乳腺输送到乳汁中的营养素。不易通过乳腺输送到乳汁中的营养素是铁（A对BCDE错）。